治疗慢性肺源性心脏病痰浊壅肺证的代表方是
A. 越婢加半夏汤
B. 涤痰汤
C. 真武汤
D. 苏子降气汤
E. 补肺汤

正确答案：D。苏子降气汤

解析：慢性肺源性心脏病痰浊壅肺证的病机为素体中阳不足，津液不布，痰湿内生，痰浊壅肺，肺失宣降，故当治以健脾益肺，化痰降气，方药选用化痰降气的苏子降气汤加减（D对）。越婢加半夏汤（A错）的功效可清肺化痰，降逆平喘，用于治疗痰热郁肺证。涤痰汤（B错）可涤痰开窍，熄风止痉，用于治疗痰蒙神窍证。真武汤（C错）可温肾健脾，化饮利水，用于治疗阳虚水泛证。补肺汤（E错）可补肺纳肾，降气平喘，用于治疗肺肾气虚证。